内燥常见于
A. 肺胃大肠
B. 肺脾肾
C. 肺胃肾
D. 肺肾大肠
E. 肺脾胃

正确答案：A。肺胃大肠

解析：内燥病变可发生于各脏腑组织，以肺、胃及大肠（A对）为多见。内燥病变，临床多见津液亏少枯涸之症，如肌肤干燥不泽，起皮脱屑，甚则皲裂，口燥咽干唇焦，舌上无津或龟裂，鼻干目涩少泪，爪甲脆折，大便燥结，小便短少等。如以肺燥为主，还兼见干咳无痰，甚则咯血；以胃燥为主时，可见食少、舌干无苔；若系肠燥，则兼见便秘等症。